种植体周围炎的治疗不同于慢性牙周炎的是
A. 指导菌斑控制
B. 清除菌斑和牙石
C. 消除过重的咬合负荷
D. PD≥6mm伴探诊出血应使用抗生素
E. PD≥5mm者可手术治疗

正确答案：D。PD≥6mm伴探诊出血应使用抗生素

解析：本题考查种植体周围炎的治疗。种植体周围炎的治疗不同于慢性牙周炎的是PD≥6mm伴探诊出血应使用抗生素（D对）。种植体周围炎与慢性牙周炎的治疗共同点包括指导菌斑控制，清除菌斑和牙石（AB错）；消除过重的咬合负荷，以消除咬合创伤（C错）。慢性牙周炎患者多数在经过龈下刮治后可恢复健康状态，一般不需要使用抗生素；但种植体周围炎在PD≥6mm伴探诊出血，并有X线片显示骨吸收时，必须使用抗生素。慢性牙周炎，PD≥5mm者应进行牙周翻瓣手术；种植体周围炎，PD≥5mm时应进行切除性手术或引导性骨再生术（E错）。